成熟红细胞中不存在
A. 糖酵解
B. 糖的有氧氧化
C. 磷酸戊糖途径
D. 2'3'-BPG旁路
E. 葡糖醛酸途径

正确答案：B。糖的有氧氧化